患维生素D缺乏性佝偻病的9～10个月婴儿多见的骨骼改变是
A. 颅骨软化
B. 肋骨串珠
C. 方颅
D. 鸡胸
E. 肋膈沟

正确答案：B。肋骨串珠

解析：患有维生素D缺乏性佝偻病的患儿若早期未经治疗，继续加重，出现PTH功能亢进和钙、磷代谢失常的典型骨骼改变，表现部位与该年龄骨骼生长速度较快的部位相一致。6月龄以内的患儿主要表现为颅骨软化（A错），至7-8月时，呈方颅样改变（C错），9-10个月婴儿多见的骨骼改变是佝偻病串珠（B对）、“鸡胸样”畸形（D错）、肋膈沟（E错）多在1岁左右患儿多见。